对结核杆菌有高度选择性，抗菌作用强
A. 异烟肼
B. 利福平
C. 两者均有
D. 两者均无

正确答案：A。异烟肼